反映两变量间相关关系可绘制
A. 直方图
B. 圆图
C. 散点图
D. 直条图
E. 线图

正确答案：C。散点图

解析：散点图（C对）是用点的密集程度和变化趋势表示两指标之间的直线或曲线关系，反映两变量间相关关系。直方图（A错）主要用于表示连续变量频数分布情况，用直条矩形面积代表各组频数，各矩形面积总和代表频数的总和。圆图（B错）常用于描述构成比资料，把圆的总面积作为100%来表示事物的全部，以圆内各扇形面积表示各部分所占的比例。直条图（D错）是描述定性数据的统计图，用等宽直条的长短表示相互独立的统计指标数值大小。线图（E错）是用线段的升降来表示变量的连续变化情况，适用于描述一个变量随另一个变量变化的趋势，通常横坐标是时间变量，纵坐标是统计指标。